既可以通过口腔给药，又可以通过鼻腔、皮肤或肺部给药的剂型是
A. 口服液
B. 吸入制剂
C. 贴剂
D. 喷雾剂
E. 粉雾剂

正确答案：D。喷雾剂

解析：本题考查喷雾剂。既可以通过口腔给药，又可以通过鼻腔、皮肤或肺部给药的剂型是喷雾剂（D对）；口服液体制剂（A错）口服给药，经胃肠道吸收发挥全身治疗作用；吸入制剂（B错）指以气溶胶或蒸汽形式递送至肺部发挥作用；贴剂（C错）指贴敷在皮肤上产生全身性或局部作用；粉雾剂（E错）是指以干粉形式进入呼吸道发挥全身或局部作用。